营养性巨幼细胞贫血
A. RBC大小不等，小的为多，中央苍白区大
B. RBC较小呈球形
C. RBC大小不等，大的为多，中央苍白区不明显
D. RBC大小不等，可见异型、靶型和有核红细胞
E. RBC大小不等，大红细胞苍白区明显

正确答案：C。RBC大小不等，大的为多，中央苍白区不明显

解析：本题考查营养性巨幼细胞贫血的血象特点。营养性巨幼细胞贫血的血象特点为RBC大小不等，大的为多，中央苍白区不明显（C对ABDE错）。